比较甲、乙两地的死亡率大小，要用哪个指标
A. RR
B. AR
C. OR
D. SMR
E. AR%

正确答案：D。SMR